用于比较传染病传染力的强弱，分析传染病流行因素及评价防疫措施的效果
A. 引入率
B. 续发率
C. 死亡率
D. 病死率
E. 发病率

正确答案：B。续发率